具有杀菌作用强价格低廉副作用少口服等优点的最重要的治疗结核病的药物是
A. 异烟肼
B. 利福平
C. 链霉素
D. 吡嗪酰胺
E. 乙胺丁醇

正确答案：A。异烟肼

解析：异烟肼是最重要的治疗结核病的药物之一，其特点是杀菌作用强、价格低廉、副作用少、能口服等（A对）。利福平可抑制分支杆菌和其他微生物的DNA依赖性RNA多聚酶，阻碍RNA合成，而对哺乳动物的RNA多聚酶无影响（B错）。链霉素为广谱氨基糖苷类抗生素，抗结核作用仅次于异烟肼和利福平，但穿透力弱，易产生耐药性（C错）。吡嗪酰胺有独特的杀菌作用，能杀灭酸性环境中的结核菌，可用于各种结核的低剂量、短程化疗，常用于其他抗结核药治疗失败的复治患者（D错）。乙胺丁醇对所有类型的结核分支杆菌均有高度抗菌活性，在与其他抗结核药物联用可延缓细菌对其他药物产生耐药性（E错）。